下列各项，不属于胆郁痰扰证临床表现的是
A. 胆怯易惊，惊悸不宁
B. 失眠多梦，烦躁不安
C. 胸胁胀闷，善太息
D. 舌淡红或红，苔白腻
E. 胁肋胀痛，身目发黄

正确答案：E。胁肋胀痛，身目发黄

解析：胆郁痰扰证是由于痰热内扰，胆气不宁所致。痰热内扰，胆气不宁，失于决断，故胆怯易惊，惊悸不宁（A对），失眠多梦，烦躁不安（B对）；胆失疏泄，气机不利，则胸胁闷胀，善太息（C对）；舌淡红或红，苔白腻，也为痰热内盛之象（D对）。胁肋胀痛，身目发黄多由肝胆湿热所致（E错，为本题正确答案）。